铬是人体必须的微量元素，但过量的摄入可致损害，下列哪项描述是错误的
A. 6价铬的毒性比3价铬的毒性要小100倍
B. 铬具有强烈的刺激性和腐蚀性
C. 铬具有明显的致突变作用
D. 铬具有很强的致癌作用
E. 6价铬的毒性比3价铬的毒性要大100倍

正确答案：A。6价铬的毒性比3价铬的毒性要小100倍

解析：本题考查铬的相关内容。铬是一种重要的微量元素，它可以通过食物和水的摄入而进入人体，但是过量的摄入可能会对人体造成损害。铬有两种形态，即3价铬和6价铬，其中6价铬比3价铬更容易被人体吸收，因此6价铬的毒性更强。6价铬具有强烈的刺激性和腐蚀性（B对），它可以通过改变DNA的结构来致突变（C对），并且具有很强的致癌作用（D对），其毒性比3价铬毒性要大（A错，为本题正确答案）100倍（E对）。